孕妇足月顺产，5天前出现高热，3天前出现腹痛腹胀等。查体:T39.8℃，BP80/50mmHg，肺部湿啰音，意识模糊，全腹压痛、反跳痛、肌紧张，最可能的疾病是
A. 脓毒性休克
B. 阴道炎
C. 宫颈炎
D. 阑尾炎
E. 感染性休克

正确答案：A。脓毒性休克

解析：孕妇足月顺产，5天前出现高热，3天前出现腹痛腹胀等，有产褥感染的表现，查体:T39.8℃（高热），BP80/50mmHg（低），肺部湿啰音（全身中毒），意识模糊（休克表现），全腹压痛、反跳痛、肌紧张（急性腹膜炎症状，提示腹腔内伴有较严重的感染），是由于病原体大量进入血液循环，繁殖并释放毒素，全身中毒表现，诊断为脓毒性休克（A对）。阴道炎（B错）有外阴瘙痒、白带异常等。宫颈炎（C错）有白带增多，肉眼见宫颈红肿，宫颈管粘膜充血、水肿。阑尾炎（D错）一般为转移性右下腹痛。脓毒血症可形成严重感染性休克（E错）或及多器官功能衰竭。